骶丛来自哪些脊神经前支
A. 腰4、5,骶尾全部
B. 腰5,骶尾全部
C. 骶尾全部
D. 骶3、4、5,尾1
E. 骶4、5,尾1

正确答案：A。腰4、5,骶尾全部

解析：骶丛由由第4腰神经前支的部分纤维和第5腰神经前支的所有纤维及所有骶、尾神经前支组成（A对）。